治疗细菌性痢疾，应首选
A. 青霉素
B. 阿奇霉素
C. 氯霉素
D. 环丙沙星
E. 复方新诺明

正确答案：D。环丙沙星

解析：环丙沙星（D对）为合成的第三代喹诺酮类药物，喹诺酮类药物抗菌谱广，杀菌作用较强，口服吸收好，对痢疾杆菌有良好的抗菌效果，为成人菌痢的首选药物。青霉素（A错）属于β⁻内酰胺类抗菌素，其抗菌谱较窄，主要对革兰氏阳性菌有效，常用于治疗肺炎、败血症等。阿奇霉素（B错）为第二代大环内酯类药物，主要用于治疗呼吸道及生殖道感染。氯霉素（C错）属抑菌性广谱抗生素，是治疗伤寒、副伤寒的首选药，为治疗厌氧菌感染的特殊药物之一，其次可用于敏感微生物所致的各种感染性疾病的治疗，由于对造血系统有不良反应严重，现已少用。复方新诺明（E错）为磺胺类抗菌药，对大肠埃希菌、流感嗜血杆菌、金黄色葡萄球菌抗菌作用明显，常用于敏感菌所致的尿路感染、急性中耳炎、肠道感染，为治疗卡氏肺孢子虫肺炎的首选药物。